下列除哪味药外，均能利咽消肿
A. 马勃
B. 山豆根
C. 板蓝根
D. 射干
E. 苦参

正确答案：E。苦参

解析：苦参的功效是清热燥湿，杀虫，利尿不具有利咽消肿的功效（E对）。马勃的功效是清热解毒，利咽，止血（A错）。山豆根的功效是清热解毒，利咽消肿（B错）。板蓝根的功效是清热解毒，凉血，利咽（C错）。射干的功效是清热解毒，消痰，利咽（D错）。